正常情况下，最易引起牙本质敏感症的釉牙骨质界结构为
A. 少量牙骨质覆盖在牙釉质表面
B. 多量牙骨质覆盖在牙釉质表面
C. 牙釉质与牙骨质端端相接
D. 牙釉质与牙骨质分离
E. 以上都不是

正确答案：D。牙釉质与牙骨质分离

解析：釉牙骨质界釉质和牙骨质在牙颈部相连，其相连处有三种不同情况：约有60％是牙骨质少许覆盖在釉质上；约30％是釉质和牙骨质端端相连；还有10％是两者不相连，该处牙本质暴露，而为牙龈所覆盖。在后一种情况下，一旦牙龈萎缩，暴露牙本质即容易发生牙本质过敏。掌握“牙本质敏感症”知识点。